下列各项中，不属于大椎穴主治病证的是
A. 热病疟疾
B. 项强脊痛
C. 癫狂惊风
D. 痢疾脱肛
E. 风疹痤疮

正确答案：D。痢疾脱肛

解析：大椎属于督脉腧穴，位于第7颈椎棘突下凹陷中，后正中线上。大椎主治：①热病、疟疾（A对）、恶寒发热、咳嗽、气喘等外感病证，临床多为退热要穴②骨蒸潮热③癫狂痫证、小儿惊风等神志病（C对）④项强，脊痛（B对）⑤风疹，痤疮（E对）。无收涩升提等治疗痢疾脱肛之效（D错，为本题正确答案）。